对刃颌位是指
A. 下颌相对于上颌位于ICP前方的下颌位置
B. 下颌前伸至最大前伸位并保持咬合接触时的颌位，此时只有后牙接触，前牙不接触
C. 若有妨碍前牙咬合的后牙接触则称为前伸（牙合）后牙（牙合）干扰
D. 下颌向一侧运动，该侧（工作侧）上下牙外侧牙尖相接触，对侧牙（非工作侧）不接触
E. 下颌向前运动到上、下颌前牙切缘相对时下颌的位置，它是前牙咬切食物时下颌的一个功能性位置

正确答案：E。下颌向前运动到上、下颌前牙切缘相对时下颌的位置，它是前牙咬切食物时下颌的一个功能性位置

解析：对刃颌位指下颌向前运动到上、下颌前牙切缘相对时下颌的位置，它是前牙咬切食物时下颌的一个功能性位置。掌握“下颌姿势位、三类颌位与前伸、侧方（牙合）颌位”知识点。